常作为生物碱薄层色谱或纸色谱的显色剂是
A. 亚硝酰铁氰化钠试剂
B. 碘化铋钾试剂
C. 间二硝基苯试剂
D. 3，5-二硝基苯甲酸试剂
E. 邻二硝基苯试剂

正确答案：B。碘化铋钾试剂

解析：本题考查的是生物碱的沉淀反应。常作为生物碱薄层色谱或纸色谱的显色剂是碘化铋钾试剂（B对）。生物碱沉淀反应的应用：生物碱沉淀反应主要用于检查中药或中药制剂中生物碱的有无，在生物碱的定性鉴别中，这些试剂可用于试管定性反应，或作为薄层色谱和纸色谱的显色剂（常用碘化铋钾试剂）。亚硝酰铁氰化钠试剂（A错）、间二硝基苯试剂（C错）、3，5-二硝基苯甲酸试剂（D错）可与甲型强心苷产生颜色反应。C-17位上不饱和内酯环的颜色反应：甲型强心苷在碱性醇溶液中，由于五元不饱和内酯环上的双键移位产生C-22活性亚甲基，能与活性亚甲基试剂作用而显色。乙型强心苷在碱性醇溶液中，不能产生活性亚甲基，无此类反应。所以利用此类反应，可区别甲、乙型强心苷。所产生的有色化合物在可见光区常有最大吸收，故亦可用于定量。鉴别反应如下：①Legal反应：又称亚硝酰铁氰化钠试剂反应。取样品1～2mg，溶于2～3滴吡啶中，加3%亚硝酰铁氰化钠溶液和2mol/L氢氧化钠溶液各1滴，反应液呈深红色并渐渐褪去。②Raymond反应：又称间二硝基苯试剂反应。取样品约1mg，以少量50%乙醇溶解后加入间二硝基苯乙醇溶液0.1ml，摇匀后再加入20%氢氧化钠0.2ml，反应液呈蓝紫色。③Kedde反应：又称3，5-二硝基苯甲酸试剂反应。取样品的甲醇或乙醇溶液于试管中，加入3，5-二硝基苯甲酸试剂（A液：2%的3，5-二硝基苯甲酸甲醇或乙醇溶液；B液：2mol/L氢氧化钾溶液，用前等量混合）3～4滴，溶液呈红色或紫红色。本试剂可用于强心苷纸色谱和薄层色谱显色剂，喷雾后显紫红色，几分钟后褪色。④Baljet反应：又称碱性苦味酸试剂反应。取样品的甲醇或乙醇溶液于试管中，加入碱性苦味酸试剂（A液：1%苦味酸乙醇溶液；B液：5%氢氧化钠水溶液，用前等量混合）数滴，溶液呈橙色或橙红色。此反应有时发生较慢，需放置15分钟以后才能显色。邻二硝基苯试剂（E错）可与醌类衍生物发生显色反应。Feigl反应：醌类衍生物在碱性条件下加热与醛类、邻二硝基苯反应，生成紫色化合物。